患者，男，35岁。恶心、呕吐、尿色深2天。既往有感染肝炎史。最大可能的诊断是
A. 肝硬化
B. 肝癌
C. 急性胆囊炎
D. 慢性乙型肝炎
E. 急性肾炎

正确答案：D。慢性乙型肝炎

解析：中年男性患者，既往有感染肝炎史。恶心、呕吐（可见于多种疾病，是肝功能受损的常见症状之一）、尿色深（提示尿胆红素升高，常见于肝功能受损）2天。综合患者的既往史及现病史，初步考虑为慢性肝炎急性发作所致肝功能受损，我国慢性肝炎以乙型肝炎为主，因此，该患者最大可能的诊断是慢性乙型肝炎（D对）。肝硬化（八版内科学P421）（A错）常伴有肝病面容及蜘蛛痣等特征性体征，且有较长的慢性肝炎或饮酒史，常需影像学检查辅助诊断。肝癌（八版内科学P430）（B错）常有较长时间的肝功能失代偿表现及肝区疼痛，本病患者症状较轻、时间短，暂不考虑肝癌。急性胆囊炎（C错）无尿色深的表现。急性肾炎（八版内科学P469）（E错）常有上呼吸道感染史，且表现为血尿、蛋白尿、水肿及高血压。